某机械厂喷漆车间女工，从事喷漆作业已十余年。近来感觉头痛、乏力及记忆力减退。并易患感染及常见皮下出血点。血象检查中性粒细胞低于1.5×10⁹/L，应考虑诊断为
A. 急性苯中毒
B. 慢性苯中毒观察对象
C. 慢性轻度苯中毒
D. 慢性中度苯中毒
E. 慢性重度苯中毒

正确答案：D。慢性中度苯中毒

解析：本题考查慢性中度苯中毒的诊断。慢性中度苯中毒多有较长时间密切接触苯的职业史，可伴有头晕、头痛、乏力、失眠、记忆力减退、易感染等症状，并有易感染和（或）出血倾向。而且具备下列条件之一：①白细胞计数低于4×10⁹/L或中性粒细胞低于2×10⁹/L，伴血小板计数低于80×10⁹/L；②白细胞计数低于3×10⁹/L或中性粒细胞低于1.5×10⁹/L；③血小板计数低于60×10⁹/L。根据本题中该车间女工的症状和血象检查，应考虑诊断为慢性中度苯中毒（D对ABCE错）。